患儿，2岁，易发腹泻，形体消瘦，面色少华，毛发稀疏，不欲饮食，急躁易怒，大便糖稀，舌淡红，苔薄白，指纹淡红，其诊断是
A. 厌食，脾胃气虚证
B. 积滞，脾虚夹积证
C. 疳证，疳气证
D. 疳证，疳积证
E. 厌食，脾失健运

正确答案：C。疳证，疳气证

解析：该题主要考查疳气的症状，理解记忆即可。疳气为疳证初起阶段，由脾胃失和，纳化失健所致。以形体略瘦，食欲不振为特征。该患儿，2岁，易发腹泻，形体消瘦，面色少华，毛发稀疏，不欲饮食，急躁易怒，大便溏稀，舌淡红，苔薄白，指纹淡红，可判断为疳证的疳气证（C对）。厌食脾胃气虚证，证候不思进食，食而不化力，舌质淡，苔薄白，脉缓无力，大便溏薄夹不消化食物，面色少华，形体偏瘦，肢倦乏力（A错）。积滞脾虚夹积证，证候面色萎黄，形体消瘦，神疲肢倦，不思乳食，食则饱胀，腹满喜按，大便稀溏酸腥，夹有乳片或不消化食物残渣，舌质淡，苔白腻，脉细滑，指纹淡滞（B错）。疳证疳积证，证候形体明显消瘦，面色萎黄，肚腹膨胀，甚则青筋暴露，夜卧不宁，或见揉眉挖鼻，吮指磨牙，动作异常，食欲不振。毛发稀疏结穗，性情烦躁或善食易饥，或嗜食异物，舌淡苔腻，脉沉细而滑（D错）。厌食脾失健运，证候食欲不振，厌恶进食，食而乏味，或伴胸脘痞闷，嗳气泛恶，大便不调，偶尔多食后则脘腹饱胀，形体尚可，精神正常，舌淡红，苔薄白或薄腻，脉尚有力（E错）。